3岁女孩，反复咳嗽2个月，查体：体温正常，浅表淋巴结（-），咽（-），两肺多哮鸣音，无水泡音，反复抗生素治疗不愈，以往无呛咳病史，有过敏性鼻炎。此患儿可能诊断是
A. 喘息性支气管炎
B. 毛细血管炎
C. 肺炎
D. 气管异物
E. 咳嗽变异型哮喘

正确答案：E。咳嗽变异型哮喘

解析：3岁女孩，反复咳嗽2个月，查体：体温正常，浅表淋巴结（-），咽（-），两肺多哮鸣音，无水泡音，反复抗生素治疗不愈，以往无呛咳病史，有过敏性鼻炎等表现符合咳嗽变异型哮喘（E对）的诊断标准。而喘息性支气管炎（A错）是一种过敏性的、常与呼吸道感染有关的疾病，多有上呼吸道感染症状，患儿低热或不发热，咳嗽以刺激性干咳为主，无明显呼吸困难及喘憋等表现，故该患儿不考虑此病。毛细血管炎（B错）是一种婴幼儿较常见的下呼吸道感染，多见于1～6个月的小婴儿，以喘息、三凹征和气促为主要临床特点。肺炎（C错）由不同病原体或其他因素（如吸入羊水、油类或过敏反应等）所引起的肺部炎症。主要临床表现为发热、咳嗽、气促、呼吸困难和肺部固定性中、细湿啰音，故该患儿不考虑此病。气管异物（D错）有异物吸入史，突然出现呛咳，可有肺不张和肺气肿等表现，故该患儿不考虑此病。